患者小便热涩刺痛，尿色深红，夹有血块，心烦，舌苔黄，脉滑数。其治法是
A. 清热泻火，利湿通淋
B. 滋阴清热，补虚止血
C. 化瘀通淋，凉血止血
D. 清热通淋，凉血止血
E. 清热利湿，通淋排石

正确答案：D。清热通淋，凉血止血

解析：本病例以小便热涩刺痛热淋为主诉，故诊断为淋证，湿热下注膀胱，热盛伤络，迫血妄行，以致小便热涩疼痛；热邪煎熬阴血，形成瘀血，随尿而出，故或夹有血块；肾阴不足，虚火灼络，络伤血溢，则见尿色深红；心火亢盛，则见心烦，舌苔黄，脉滑数为实热之象，故诊断为血淋，治以清热通淋，凉血止血，代表方为小蓟饮子（D对）。清热泻火，利湿通淋，是热淋的治法（A错）。滋阴清热，补虚止血，是血淋之久病肾阴不足，虚火扰动阴血的治法(B错)。化瘀通淋，凉血止血，适用于淋证之兼夹瘀血者（C错）。清热利湿，通淋排石，是石淋的治法（E错）。